药品的含量不符合国家药品标准规定含量的是
A. 假药
B. 药品
C. 劣药
D. 新药
E. 辅料

正确答案：C。劣药

解析：劣药，是指药品成分含量不符合国家药品标准规定的药品（C对）。假药，是指药品所含成分与国家药品标准规定的成分不符，以及以非药品冒充药品或者以他种药品冒充此种药品的（A错）。药品，是指用于预防、治疗、诊断人的疾病，有目的地调节人的生理机能并规定有适应证或者功能主治、用法和用量的物质，包括中药材、中药饮片、中成药、化学原料药及其制剂、抗生素、生化药品、放射性药品、血清、疫苗、血液制品和诊断药品等（B错）。新药是指化学结构、药品组分和药理作用不同于现有药品的药物。根据《药品管理法》，新药系指未曾在中国境内上市销售的药品（D错）。辅料，是指生产药品和调配处方时所用的赋形剂和附加剂（E错）。